以下哪种囊肿不属于发育性囊肿
A. 鳃裂囊肿
B. 鼻腭囊肿
C. 血外渗性囊肿
D. 球上颌囊肿
E. 甲状舌管囊肿

正确答案：C。血外渗性囊肿

解析：本题考查口腔颌面部囊肿分类。血外渗性囊肿为损伤后引起骨髓内出血、机化、渗出后形成，不属于发育性囊肿（C错，为本题的正确答案）。鳃裂囊肿来自鳃裂或咽囊的上皮剩余，属于发育性囊肿（A对）。非牙源性囊肿属于发育性囊肿，包括鼻腭管囊肿（B对）、球状上颌囊肿（D对）、正中囊肿以及鼻唇囊肿。胚胎发育过程中，若甲状舌管不消失时，残存上皮分泌物聚积可形成先天性甲状舌管囊肿，属于发育性囊肿（E对）。